对蛋类营养价值描述错误的是
A. 蛋类含蛋白质一般都在10%以上
B. 蛋清中含脂肪极少，98%的脂肪在蛋黄内
C. 蛋黄是磷脂的良好食物来源
D. 蛋黄中富含铁，其生物利用率也很高
E. 蛋类维生素含量较为丰富，而且种类较为齐全

正确答案：D。蛋黄中富含铁，其生物利用率也很高

解析：本题考查蛋类的营养价值。蛋类的矿物质主要存在于蛋黄内，蛋黄中的铁含量虽然较高，但由于是非血红素铁，并与卵黄高磷蛋白结合，生物利用率仅为3%左右（D错，为本题正确答案）。蛋类含蛋白质一般在10%以上（A对）。蛋清中含脂肪极少，98%的脂肪集中在蛋黄内（B对）。蛋黄是磷脂的良好食物来源（C对），蛋黄中的磷脂主要是卵磷脂和脑磷脂，除此之外还有神经鞘磷脂。蛋类维生素含量较为丰富，而且种类较为齐全（E对）。